牛黄上清丸功效
A. 清热泻火，散风止痛
B. 散风清热，泻火解毒
C. 疏风解表，清热解毒
D. 清热疏风，利咽解毒
E. 清热化湿，行气止痛

正确答案：A。清热泻火，散风止痛

解析：本题考查牛黄上清丸的功能。牛黄上清丸功效为清热泻火，散风止痛（A对）。牛黄上清丸（胶囊、片）【功能】清热泻火，散风止痛。黄连上清丸（颗粒、胶囊、片）【功能】散风清热，泻火止痛（B错）。双黄连合剂（口服液、颗粒、胶囊、片）【功能】疏风解表，清热解毒（C错）。清咽滴丸【功能】疏风清热，解毒利咽（D错）。香连丸（片）【功能】清热化湿，行气止痛（E错）。